下列关于药物过敏性口炎的临床特征描述正确的为
A. 皮肤大疱，口腔黏膜白色瘢痕
B. 皮肤紫色丘疹，口腔内白色条纹
C. 皮肤红斑、水疱，口腔大小不等水疱、糜烂
D. 皮肤水疱或斑丘疹，口腔内相互融合的透明小水疱
E. 皮肤结节性红斑，口腔内反复发作的溃疡

正确答案：C。皮肤红斑、水疱，口腔大小不等水疱、糜烂

解析：本题考查药物过敏性口炎的临床特征。药物过敏性口炎是指药物经过各种途径进入体内后，使过敏体质者发生超敏反应而引起的黏膜或皮肤的超敏反应性疾病。药物过敏性口炎可单发于口腔黏膜，也可伴有皮肤及其他部位黏膜的病损。皮肤损害表现为皮肤红斑、水疱，口腔损害表现为口腔大小不等水疱、糜烂（C对）。皮肤大疱，口腔黏膜白色瘢痕（A错）为类天疱疮的临床特征。皮肤紫色丘疹，口腔内白色条纹（B错）为扁平苔藓的临床特征。皮肤水疱或斑丘疹，口腔内相互融合的透明小水疱（D错）为单纯疱疹的临床症状。皮肤结节性红斑，口腔内反复发作的溃疡（E错）可为多形性红斑的临床特征。